晚期流产的常见原因
A. 宫颈内口松弛
B. 黄体功能不全
C. 严重感染
D. 甲状腺功能减退
E. 不良刺激

正确答案：A。宫颈内口松弛

解析：宫颈内口松弛和宫颈重度裂伤引发胎膜早破，导致晚期流产，为最常见的原因。掌握“自然流产”知识点。